男性，56岁。食欲减退半年，巩膜轻度黄染，肝肋下及边。血红蛋白80g/L，红细胞3.1✕10¹²/L，网织红细胞2%。骨髓象示幼红细胞增生活跃，中、晚幼红细胞为主，幼红细胞体积小，胞质少、边缘不整，粒细胞系及巨核细胞系正常。诊断
A. 巨幼细胞贫血
B. 缺铁性贫血
C. 溶血性贫血
D. 再生障碍性贫血
E. 肝病性贫血

正确答案：B。缺铁性贫血